下列关于腮腺与面神经的关系的叙述，正确的是
A. 第二段在面神经干从茎乳孔穿出到进入腮腺前的一段
B. 乳突前缘标志、鼓乳裂标志是显露面神经主干的参考标志
C. 第三段在腮腺内
D. 显露面神经主干可在第二段进行
E. 第一段呈放射状分布于面部表情肌的一段

正确答案：B。乳突前缘标志、鼓乳裂标志是显露面神经主干的参考标志

解析：腮腺与面神经关系密切，根据面神经在颅外的行程及其与腮腺的关系，将其分为三段，第一段指面神经干从茎乳孔穿出到进入腮腺前的一段，显露面神经主干可在此处进行；第二段在腮腺内；第三段为面神经五组分支从腮腺边缘走出，呈放射状分布于面部表情肌的一段。显露面神经主干的参考标志有乳突前缘标志、鼓乳裂标志、外耳道软骨标志、茎突标志、二腹肌后腹标志。掌握“腮腺咬肌区、腮腺与面神经解剖关系”知识点。